下列传染病学常见出疹时间，错误的是
A. 水痘多在第1病日
B. 猩红热多在第2病日
C. 天花多在第3病日
D. 麻疹多在第4病日
E. 伤寒多在第5病日

正确答案：E。伤寒多在第5病日

解析：如水痘、风疹多于病程的第1天出皮疹（A对），猩红热多于第2天（B对），麻疹多于第3天（D对），斑疹伤寒多于第5 天，伤寒多于第6天（E错，为本题正确答案）。天花多在第3病日发疹（C错）。